女性，20岁。左侧上颌后牙自发性肿痛，吸吮时出血3天。4天前曾有过鱼刺刺伤史。口腔检查左上67牙间探诊疼痛明显，牙龈乳头红肿，叩诊（+），无松动，未探及牙周袋。下列应急处理方法恰当的是
A. 去除患牙牙石等刺激因素
B. 3％过氧化氢溶液及生理盐水交替冲洗牙间乳头
C. 局部敷以2％碘甘油
D. 用0．2％氯己定溶液含漱
E. 以上均是

正确答案：E。以上均是

解析：根据患者的口腔检查结果和症状可判断该患者患有急性龈乳头炎，被鱼刺刺伤是引起该患者发生急性龈乳头炎的直接病因，龈乳头有炎症时表现为牙龈乳头发红肿胀，探触和吸吮时易出血，有自发性的胀痛和明显的探触痛。急性龈乳头炎的治疗原则之一为去除患牙牙石等刺激因素（A对）以消除或缓解龈乳头的急性炎症。3％过氧化氢溶液与生理盐水交替冲洗牙间乳头（B对）有清创、止血、灭菌、除臭等作用，可抑制厌氧菌的生长。局部敷以2％碘甘油（C对）具有一定的抑菌、消炎收敛作用。0.2%氯己定溶液（D对）是牙周局部药物治疗中常用的含漱药物，含漱后能明显减少菌斑的形成。（ABCD均对，故E为本题的正确答案）。